以下关于股骨干骨折出血，处理错误的是
A. 止血带固定到手术结束
B. 结扎创面小血管止血
C. 持续牵引
D. 钢板螺钉内固定
E. 尽早进行肌肉，膝关节功能练习

正确答案：A。止血带固定到手术结束

解析：止血带固定要持续关注牵引力是否足够，若牵引力过大，导致过度牵引，骨折端出现间隙，将会发生骨折延迟愈合或不愈合，故止血带固定到手术结束为处理错误的行为（A错，为本题正确答案）。持续牵引（C对）、尽早进行肌肉，膝关节功能练习（E对）股骨干骨折出血非手术治疗，结扎创面小血管止血（B对）、钢板螺钉内固定（D对）为股骨干骨折出血手术治疗。